含有季铵结构，不易进入中枢，用于平喘的药物
A. 硫酸阿托品
B. 氢溴酸东莨菪碱
C. 氢溴酸后马托品
D. 异丙托溴铵
E. 丁溴酸东莨菪碱

正确答案：D。异丙托溴铵

解析：本题考查常用药物的结构特征与作用。异丙托溴铵（D对）为M胆碱受体拮抗剂类平喘药，药物分子中含有季胺药效团，可以有效地防止该类药物进入中枢神经系统，减少对中枢的作用；硫酸阿托品（A错）是一种抗胆碱药，与M胆碱受体结合；氢溴酸东莨菪碱（B错）含有氧桥结构，中枢作用较强，用于预防和治疗晕动症；氢溴酸后马托品（C错）含有α-羟基苯乙酸酯结构，为M胆碱受体阻断剂，具有阻断乙酰胆碱的作用；丁溴东莨菪碱（E错）为东莨菪碱季铵化得到的药物，为外周抗胆碱药。